65岁以上老人进行膳食咨询不适宜的是
A. 饮食多样性
B. 少盐多糖
C. 每天饮用牛奶
D. 饮食清淡
E. 适量食用动物食品

正确答案：B。少盐多糖

解析：随着身体机能的下降，老年人在摄入盐分和糖分时也应注意适量，不能少盐多糖（B错，为本题正确答案），预防糖尿病的发生。老年人合理膳食原则：①平衡膳食：②控制脂肪摄入：③蛋白质以优质蛋白为主：④碳水化合物以淀粉为主：⑤保证充足的新鲜蔬菜和水果的摄入：⑥重视补充钙铁锌等矿物质：⑦食物荤素搭配、粗细搭配：⑧少食多餐，不暴饮暴食，饮食清淡少盐，不吸烟少饮酒。